失血性休克发展过程中，全身外周阻力变化趋势是：
A. 增加
B. 降低
C. 先增加后降低
D. 先降低后增加
E. 不变

正确答案：C。先增加后降低

解析：先增加后降低（C对）是全身外周阻力在失血性休克发展过程中的变化趋势。失血性休克病程分为三期：微循环缺血期、微循环淤血期、微循环衰竭期， 微循环缺血期：在回心血撮和心排血量增加的基础上，全身小动脉痉挛收缩，可使外周阻力增高，血压回升；微循环淤血期：本期因微血管反应性下降，血液大量淤滞在微循环内，外周阻力下降；微循环衰竭期：此期微血管发生麻痹性扩张，毛细血管大量开放，微循环中可有微血栓形成，血流停止，出现不灌不流状态，外周阻力进一步下降。